产生慢性危害的根本原因是
A. 低浓度的环境污染物对机体损害的逐渐积累
B. 环境污染物的毒性高
C. 环境污染物之间的联合作用
D. 低浓度的环境污染物经口吸收
E. 低浓度的环境污染物经呼吸道吸收

正确答案：A。低浓度的环境污染物对机体损害的逐渐积累

解析：本题考查环境污染产生慢性危害的根本原因。环境中有害因素低浓度、长时间反复作用于机体所产生的危害,称为慢性危害。环境化学污染物或有害的物理因素长期暴露均可造成慢性危害。慢性危害的产生与污染物的暴露剂量﹑暴露时间、化学污染物的生物半减期和化学特性，机体的反应特性等有关。低浓度的环境污染物在机体内的物质或功能蓄积（A对BCDE错）是产生慢性危害的根本原因。